处方组成有大黄，功能消积导滞、清利湿热的药是
A. 保和丸
B. 越鞠丸
C. 六味安消散
D. 枳实导滞丸
E. 开胃健脾丸

正确答案：D。枳实导滞丸

解析：本题考查的是枳实导滞丸的药物组成和功能。处方组成有大黄，功能消积导滞、清利湿热的药是枳实导滞丸（D对）。枳实导滞丸：【药物组成】枳实（炒）、大黄、六神曲（炒）、黄芩、黄连（姜汁炒）、茯苓、白术（炒）、泽泻。【功能】消积导滞，清利湿热。保和丸（A错）：【药物组成】焦山楂、六神曲（炒）、莱菔子（炒）、麦芽（炒）、半夏（制）、陈皮、茯苓、连翘。【功能】消食，导滞，和胃。越鞠丸（B错）：【药物组成】香附（醋制）、川芎、栀子（炒）、苍术（炒）、六神曲（炒）。【功能】理气解郁，宽中除满。六味安消散（C错）：【药物组成】藏木香、大黄、山柰、北寒水石（煅）、诃子、碱花。【功能】和胃健脾，消积导滞，活血止痛。开胃健脾丸（E错）：【药物组成】白术、党参、茯苓、山药、六神曲（炒）、麦芽（炒）、山楂、木香、砂仁、陈皮、肉豆蔻（煨）、黄连、甘草（炙）。【功能】健脾和胃。